依那普利与利尿药合用，可增强
A. 神经系统毒性
B. 中枢兴奋作用
C. 降压作用
D. 低血钾
E. 骨髓抑制

正确答案：C。降压作用

解析：本题考查药物的相互作用。依那普利与利尿药合用，可增强降压作用（C对）。ACEI或ARB+噻嗪类利尿剂：利尿剂的不良反应是激活RAAS,造成一些不利于降低血压的负面作用；与ACEI或ARB合用则抵消其激活RAAS的不利因素。而ACEI和ARB可使血钾水平略有上升，能拮抗噻嗪类利尿剂长期应用所致的低血钾等不良反应。因此二者合用有协同作用并可互相抵消不良反应。